患者证见泄泻腹痛，泻而不爽，粪便黄褐而臭，肛门灼热，烦热口渴，舌苔黄腻，脉滑数，最佳方剂为
A. 葛根芩连汤
B. 芍药汤
C. 白头翁汤
D. 黄芩汤
E. 痛泻药方

正确答案：A。葛根芩连汤

解析：湿热之邪，或夏令暑湿伤与脾胃，传化失常故发于泄泻腹痛；湿热郁结故而烦热口渴；湿热下注故肛门灼热，粪便黄褐而臭，泻而不爽，小便短黄；舌苔黄腻，脉滑数，均为泄泻肠道湿热证，治疗需清热利湿，代表方为葛根芩连汤加减（A对）。芍药汤（B错）可以清热燥湿，调气和血，用于治疗湿热痢疾。白头翁汤（C错）可以清热解毒，凉血止痢，用于治疗热毒痢疾。黄芩汤（D错）可以清热止痢，和中止痛，治疗阳邪入里之痢疾。痛泻药方（E错）可以益肝扶脾，用于治疗肝气郁滞证。